某女，50岁。患高血压病5年，症见头晕目眩、耳鸣口苦、心烦难寐，医师处以脑立清丸。此成药的功能是
A. 平肝潜阳，醒脑安神
B. 平肝潜阳，止痉安神
C. 平肝潜阳.清心安神
D. 平肝息风，化痰开窍
E. 平肝息风.养血安神

正确答案：A。平肝潜阳，醒脑安神

解析：本题考查脑立清丸的功能。此成药的功能是平肝潜阳，醒脑安神（A对）。脑立清丸（胶囊）【功能】平肝潜阳，醒脑安神。紫雪散【功能】清热开窍，止痉安神（B错）。参松养心胶囊【功能】益气养阴，活血通络，清心安神（C错）。牛黄【功效】清热解毒，息风止痉，化痰开窍（D错）。枣仁安神液（颗粒、胶囊）【功能】养血安神（E错）。